白术不能
A. 补气
B. 健脾
C. 发汗
D. 利水
E. 燥湿

正确答案：C。发汗

解析：本题考查的是白术的功效。白术不能发汗（C错，为本题正确答案）。白术：【功效】补气（A对）健脾（B对），燥湿（E对）利水（D对），止汗，安胎。发汗为麻黄的功效。麻黄：【功效】发汗解表，宣肺平喘，利水消肿。